具有“壅遏营气，令无所避”作用的是
A. 筋
B. 脉
C. 肉
D. 皮
E. 骨

正确答案：B。脉

解析：此句意为夹护控制着气血，使之无所回避地到达各部位，叫做脉。由于营气在脉中，是血液的重要组成部分，营与血关系密切，可分不可离，故常常将“营血”并称。血的运行需要脉道的完好无损与通畅无阻，血行脉中，脉为血府，脉道完好和通畅是保证血液正常运行的重要因素（B对）。